下列哪项不是宣白承气汤证具有的表现
A. 身热，痰涎壅盛
B. 腹痛
C. 便秘
D. 胸满胁痛
E. 苔黄腻，脉右寸实大

正确答案：D。胸满胁痛

解析：宣白承气汤证为肺热腑实证，既有肺经痰热壅阻，又有肠腑热结不通。痰热阻肺，肃降无权，则出现喘促不宁，右脉实大，舌苔也多见黄腻或黄滑；阳明腑实热结，腑气不通则潮热、腹痛便秘（D错，为本题正确答案）。宣白承气汤方中以生石膏清肺胃之热；杏仁、瓜蒌皮宣降肺气，化痰定喘；大黄攻下腑实。